能开郁顺气、调经养血的中成药是
A. 七制香附丸
B. 养血调经膏
C. 益母草颗粒
D. 乌鸡白凤丸
E. 妇康宝口服液

正确答案：A。七制香附丸

解析：本题考查的是七制香附丸的功能。能开郁顺气、调经养血的中成药是七制香附丸（A对）。七制香附丸：【功能】舒肝理气，养血调经。益母草颗粒（C错）：【功能】活血调经。乌鸡白凤丸（D错）：【功能】补气养血，调经止带。养血调经膏（B错）与妇康宝口服液（E错）的功能，2022年考试指南未明确说明。